男性，25岁。主诉心前区疼痛2小时，向左肩放射，吸气时疼痛加重，坐位时减轻，伴有畏寒、发热就诊，体检：血压105/75mmHg，体温38度，心率110次/分，规则，心脏无杂音，两肺未见异常，有血吸虫病史。心电图示除aVR与V1外各导联ST段抬高。本例正确治疗是
A. 手术取出栓子
B. 冠脉造影伴紧急PTCA
C. 心包穿刺
D. 大剂量抗生素静脉滴注
E. 应用升压药以及强心利尿剂

正确答案：C。心包穿刺

解析：青年男性患者，既往血吸虫病史，心前区疼痛2小时，向左肩放射，吸气疼痛加重，坐位疼痛减轻（提示心包积液），伴畏寒，发热，查体：血压105/75mmHg（正常值为90～140/60～90mmHg），体温38度（正常值为36℃～37℃，体温升高），心率110次/分（60～100次/分，心率增快且与体温不相称），心脏无杂音，两肺未见异常，心电图示除aVR与V1外各导联ST段抬高，根据该患者的病史，临床症状及体征，最可能的诊断为心包炎并伴有心包积液，该病例应行心包穿刺对心包减压并将引流液送实验室检查查明感染原因。